咳血方与小蓟饮子中均含有的药物是
A. 山栀子
B. 青黛
C. 炙甘草
D. 生地黄
E. 滑石

正确答案：A。山栀子

解析：根据考点还原可作出判断。咳血方与小蓟饮子方中含有的共同药物是山栀子（A对）。趣记：咳血方 咳血请人刻石子。――咳血青仁诃石子。小蓟饮子 六一节牧童当生煮三黄鸡。――六一节本通当生竹山黄蓟。